小建中汤组成含有的药物是
A. 人参，桂枝
B. 甘草，干姜
C. 生姜，桂枝
D. 白术，芍药
E. 大枣，人参

正确答案：C。生姜，桂枝

解析：小建中汤由饴糖、桂枝、芍药、炙甘草、大枣、生姜组成（C对）。记忆：桂枝汤加饴糖。